患者，男性，68岁，右下牙龈癌，拟行颌颈联合根治术+胸大肌、肋骨复合组织瓣修复术。该骨肌皮瓣转移修复后，应主要注意观察下列哪一项
A. 伤口渗血
B. 水肿
C. 血液循环
D. 质地
E. 感觉

正确答案：C。血液循环

解析：本题考查胸大肌、肋骨复合组织瓣修复术的术后观察。胸大肌、肋骨复合组织瓣修复术后应主要注意观察血液循环（C对）。术后72小时是游离皮瓣最容易发生血管危象的时期。动物实验及临床观察均发现，危象皮瓣能否抢救成功，取决于对微循环障碍的早起发现和对受损血管的及时探查切勿延误时机。